健康管理的载体是
A. 管理
B. 有计划有组织的系统活动
C. 服务
D. 个体
E. 群体

正确答案：C。服务

解析：本题考查健康管理的载体。健康管理的载体为服务（C对ABDE错）。